能被磷酸二酯酶直接其发热作用的物质是
A. PGE2
B. cAMP
C. Na+/Ca2+
D. IL-6
E. MIP-1

正确答案：B。cAMP

解析：磷酸二酯酶具有水解细胞内第二信使的功能，如cAMP（B对），从而直接抑制cAMP的发热作用。PGE2（A错）、Na+/Ca2+（C错）属于发热中枢正调节介质。IL-6（D错）、MIP-1（E错）属于内生致热原，都不是能被磷酸二酯酶直接其发热作用的物质。